二氧化氯消毒
A. 消毒效果稳定，受pH影响，能除臭味，成本高
B. 消毒效果稳定，不受pH影响，不与氨反应，成本高
C. 消毒效果不太稳定，不受pH影响，不与氨反应，成本高
D. 消毒效果不太稳定，受pH影响，能与氨反应，并能除臭味
E. 消毒效果稳定，不受pH影响，能与氨反应，成本高

正确答案：B。消毒效果稳定，不受pH影响，不与氨反应，成本高

解析：本题考查二氧化氯消毒的特点。二氧化氯是极为有效的饮水消毒剂，对细菌、病毒及真菌孢子的杀灭能力均很强。其消毒效果稳定，不受pH影响，不与氨反应，成本高（B对ACDE错）。